光镜下可见薄的无角化上皮，有上皮钉突伸入到结缔组织中，乳头层中常有炎症细胞浸润的上皮为
A. 结合上皮
B. 龈沟上皮
C. 牙龈上皮
D. 缩余釉上皮
E. 龈谷上皮

正确答案：E。龈谷上皮

解析：龈谷上皮表面为无角化的薄层上皮，上皮钉突伸入到结缔组织，乳头层中常有炎症细胞浸润。掌握“牙龈”知识点。